医生指导孕妇服用叶酸属于
A. 化学预防
B. 筛查
C. 健康咨询
D. 免疫接种
E. 药物治疗

正确答案：A。化学预防

解析：对孕妇补充叶酸以降低神经管缺陷儿出生的危险因素属于化学预防措施（A对）。